洁治术后不需做
A. 用尖探针检查牙石是否去净
B. 用3％过氧化氢溶液冲洗牙周袋
C. 龈沟内上药
D. 立即做根面脱敏
E. 检查牙龈是否损伤

正确答案：D。立即做根面脱敏

解析：本题考查洁治术后。运用机械手段去除根面牙石和软化牙骨质，不可避免地导致部分牙骨质甚至牙本质的丢失，引起患者根面敏感，根面脱感是否做应在洁治后根据具体情况而定，不能立即做根面脱敏（D错，为本题的正确答案），因为洁治后的牙周组织可以再生可以将暴露的牙本质覆盖，一般一周后根面敏感症状会消失，不需根面脱敏，若敏感症状持续存在再进行根面脱敏治疗。洁治术完成后需用尖探针检查牙石是否去净（A对），尤其是邻面和龈缘处，避免遗漏牙石或色渍。洁治术后一般还要用手持器械进行根面平整术，最后用3％过氧化氢溶液冲洗牙周袋（B对）以将残余的牙石碎片和肉芽组织彻底清除。消除菌斑、牙石等刺激物后，可在龈沟内上药（C对）使药物作用于残留的细菌，达到辅助治疗的目的。洁治器械洁治支点放不稳，器械易突然滑脱而损伤牙龈或口腔黏膜，因此洁治术后应检查牙龈是否损伤（E对），若损伤则进行护龈处理。